马来酸氯苯那敏治疗荨麻疹，正确的是
A. 驾车不可使用
B. 青光眼患者不可使用
C. 老年人使用会导致尿潴留
D. 红霉素会使马来酸氯苯那敏血药浓度降低
E. 使用马来酸氯苯那敏前应服用门冬氨酸钾镁

正确答案：A、B、C。驾车不可使用；青光眼患者不可使用；老年人使用会导致尿潴留

解析：本题考查荨麻疹的用药指导与患者教育。马来酸氯苯那敏为第一代抗组胺药，可透过血-脑屏障，对中枢神经系统组胺受体产生抑制作用，引起镇静、困倦、嗜睡反应，对驾车、高空作业、精密机械操作者，在工作前不得服用或在服用后间隔6小时以上再从事上述活动（A对）。对闭角型青光眼者可引起眼压增高（B对），对患有良性前列腺增生症的老年男性可能引起尿潴留（C对），给药时应予注意。红霉素为肝药酶抑制剂，会使马来酸氯苯那敏血药浓度升高（D错）。